在产地加工时需要“发汗”的药材有
A. 玄参
B. 续断
C. 厚朴
D. 黄柏
E. 茯苓

正确答案：A、B、C、E。玄参；续断；厚朴；茯苓

解析：本题考查常用的产地加工方法。在产地加工时需要“发汗”的药材有玄参（A对）、续断（B对）、厚朴（C对）、茯苓（E对）。发汗：有些药材在加工过程中为了促使变色，增强气味或减小刺激性，有利于干燥，常将药材堆积放置，使其发热、“回潮”，内部水分向外挥散，这种方法称为“发汗”，如厚朴、杜仲、玄参、续断、茯苓等。黄柏（D错）【采收加工】3～6月间采收，选10年左右的树，剥取树皮，除去粗皮，晒干。